腹痛寒邪内阻证治疗首选方剂
A. 良附丸合正气天香散
B. 大承气汤
C. 枳实导滞丸
D. 小建中汤
E. 柴胡疏肝散

正确答案：A。良附丸合正气天香散

解析：腹痛寒邪内阻证，其机理为寒邪入侵，阳气不运，气血被阻故见腹痛急暴，得温痛减，遇冷更甚，故治法为散寒温里，理气止痛，方药当选用散寒温里的良附丸合理气止痛的正气天香散加减（A对）。大承气汤可（B错）可以泻热通腑，为治疗湿热壅滞证的选方；枳实导滞丸（C错）可以消食导滞，为治疗饮食积滞证的选方；小建中汤（D错）可以温中补虚，和里缓急，为治疗中虚脏寒证的选方；柴胡疏肝散（E错）可以舒肝理气，活血化瘀，为治疗肝郁气滞证的选方。